呼气性呼吸困难见
A. 气胸
B. 喉水肿
C. 神经官能症
D. 左心衰竭
E. 喘息型慢性支气管炎

正确答案：E。喘息型慢性支气管炎

解析：呼气性呼吸困难见喘息型慢性支气管炎（E对）。吸气性呼吸困难多见于喉、气管、大支气管的炎症、水肿、肿瘤或异物等造成的气道狭窄与阻塞（B错）。混合性呼吸困难：吸气、呼气均困难，呼吸浅而快，多见于重症肺炎、重症肺结核、大面积肺不张、弥漫性肺纤维化、大量胸腔积液及气胸等（A错）。左心衰竭多见劳力性呼吸困难、端坐呼吸、夜间阵发性呼吸困难（D错）。神经症呼吸困难者自觉胸闷、憋气，主观感到空气不足，而客观上未见呼吸困难的表现（C错）。